休克初期哪种血管活性物质增多与微循环血管收缩无关？
A. 儿茶酚胺
B. 血管紧张素II
C. 前列环素(PGI2)
D. 血栓素A2(TXA2)
E. 垂体加压素

正确答案：C。前列环素(PGI2)

解析：微循环主要受神经体液的调节。全身性体液因子如儿茶酚胺（A对）、血管紧张素II（B对）、血管加压素（E对）、血栓素A2(TXA2 )（D对）和内皮素(ET)等可使微血管收缩；而局部血管活性物质如组胺、激肽、腺苷、PGI2（C错，为本题正确答案）、内啡肽、 TNF和一氧化氮(NO)等则引起血管舒张。